X线片多以高低密度混合表现为主，部分病变以低密度变化为主；病变中有不同程度钙化或骨化影，表现为点状或斑片状
A. 骨化纤维瘤
B. 骨纤维异样增殖症
C. 成釉细胞瘤
D. 牙源性角化囊性瘤
E. 组合性牙瘤

正确答案：A。骨化纤维瘤

解析：骨化纤维瘤X线片多以高低密度混合表现为主，部分病变以低密度变化为主；病变中有不同程度钙化或骨化影，表现为点状或斑片状。肿瘤和周围正常组织之间分界清晰。下颌骨下缘密质骨可有膨胀，但完整性存在；上颌骨者可占据整个上颌窦，窦壁有膨胀性改变。掌握“骨化纤维瘤”知识点。